孕产妇首先发生右心衰竭的疾病是
A. 妊娠合并二尖瓣狭窄
B. 子痫
C. 羊水栓塞
D. 重型胎盘早剥
E. 产褥感染

正确答案：C。羊水栓塞

解析：羊水栓塞（C对）可引起肺动脉高压，而肺动脉高压直接使右心负荷加重，导致急性右心扩张，并出现充血性右心衰竭。妊娠合并二尖瓣狭窄（A错）相对早期的常见并发症是心房颤动，重度二尖瓣狭窄的严重并发症是急性肺水肿，直至晚期才会出现右心衰竭。子痫（B错）不会首先发生右心衰竭，而是表现为抽搐、面部充血、口吐白沫、深昏迷，全身高张惊厥等。重型胎盘早剥（D错）可因失血过多而导致失血性休克，发生左心衰竭。产褥感染（E错）主要是发热、疼痛、异常恶露等感染表现，严重者可因感染性休克导致左心衰。